5岁小儿按公式计算身高、体重及头围约是
A. 90cm/12Kg/44cm
B. 95cm/14Kg/46cm
C. 100cm16Kg48m
D. 110cm/18Kg/50cm
E. 110cm/20Kg/52cm

正确答案：D。110cm/18Kg/50cm

解析：根据正常儿童体重、身高估计公式，5岁小儿，身高＝年龄×7+75，所以身高约为110cm；体重＝年龄×2+8，所以体重约为18kg；正常足月儿出生时头围约33～34cm，1岁时约为46cm，生后第2年头围增长缓慢，约为48cm，5岁时约为50cm，15岁时约为54～58cm，基本与成人相同。八版儿科学已删除5岁头围数据。综上所述5岁小儿身高、体重及头围约为110cm/18kg/50cm，D选项最接近此数据（D对）。